下列哪一种不属于我国现行法定职业性尘肺
A. 矽肺
B. 石棉肺
C. 炭黑尘肺
D. 铍尘肺
E. 云母尘肺

正确答案：D。铍尘肺

解析：本题考查法定职业性尘肺的分类。我国2013年公布实施的《职业病分类和目录》中，规定了十二种肺尘埃沉着病名单，即矽肺（A对）、石棉肺（B对）、煤工尘肺、石墨尘肺、炭黑尘肺（C对）、滑石尘肺、水泥尘肺、云母尘肺（E对）、陶工尘肺、铝尘肺、电焊工尘肺及铸工尘肺。法律没有规定铍尘肺（D错，为本题正确答案）为法定职业性尘肺。